要了解肾结核患者肾功能、病变程度与范围。首选的检查方法是
A. CT平扫
B. 静脉尿路造影
C. MRI
D. 逆行肾盂造影
E. B超

正确答案：B。静脉尿路造影

解析：TEST因造影剂是从肾脏分泌后显示尿路系统，因此静脉尿路造影（B对）除适用于明确肾脏病变外，还可了解分侧肾功能、病变程度与范围，典型的结核表现可见肾实质破坏，故多作为首选。CT平扫（A错）适用于肾囊肿和肾实质性病变、肿瘤的诊断和分期、转移性淋巴结，不适用肾功能的检查，但CT尿路成像（CTU）可以。MRI（C错）适用于静脉尿路造影失败或显影欠佳的病例。逆行肾盂造影（D错）适用于静脉尿路造影不能进行或显影不满意时，但不能像静脉尿路造影那样可了解肾功能的变化。B超（E错）适用于肾肿块性质、结石和肾积水，也不能像静脉尿路造影那样可了解肾功能的变化。